金银花与连翘均有的功效是
A. 清热解毒，凉血散结
B. 清热解毒，化痰开窍
C. 清热解毒，利湿通淋
D. 清热解毒，凉肝定惊
E. 清热解毒，疏散风热

正确答案：E。清热解毒，疏散风热

解析：本题考查的是金银花与连翘的功效。金银花与连翘均有的功效是清热解毒，疏散风热（E对）。金银花：【功效】清热解毒，疏散风热。连翘：【功效】清热解毒，疏散风热，消肿散结，利尿。玄参：【功效】清热凉血，滋阴降火，解毒散结（A错），润肠。牛黄：【功效】清热解毒，息风止痉，化痰开窍（B错）。蒲公英：【功效】清热解毒，消痈散结，利湿通淋（C错）。青黛：【功效】清热解毒，凉血消斑，定惊（D错）。